膜剂常用的着色遮光剂是
A. EVA
B. TiO₂
C. SiO₂
D. 山梨醇
E. 聚山梨酯80

正确答案：B。TiO₂

解析：本题考查膜剂的附加剂。膜剂常用的着色遮光剂是TiO₂（B对），常用的增塑剂是山梨醇，常用的成膜材料是EVA。